近中错（牙合）是指
A. 上颌第一恒磨牙的近中颊尖咬合在下颌第一恒磨牙颊沟的远中
B. 下颌第一恒磨牙的近中颊尖咬合在上颌第一恒磨牙颊沟的远中
C. 上颌第一恒磨牙的近中颊尖正对着下颌第一恒磨牙颊沟
D. 下颌第一恒磨牙的近中颊尖正对着上颌第一恒磨牙颊沟
E. 上颌第一恒磨牙的近中颊尖咬合在下颌第一恒磨牙颊沟的近中

正确答案：A。上颌第一恒磨牙的近中颊尖咬合在下颌第一恒磨牙颊沟的远中

解析：如上颌第一恒磨牙的近中颊尖咬合在下颌第一恒磨牙颊沟的远中，则称为近中错（牙合），或安氏Ⅲ类错（牙合）。掌握“牙尖交错（牙合）、前伸（牙合）及侧（牙合）”知识点。